乙脑死亡的主要原因是
A. 高热
B. 惊厥
C. 中枢性呼吸衰竭
D. 周围性呼吸衰竭
E. 休克

正确答案：C。中枢性呼吸衰竭

解析：中枢性呼吸衰竭常为乙脑死亡的主要原因（C对）。高热（A错），惊厥（B错）也是乙脑的临床表现。